上唇部分裂开，鼻底完整属于
A. Ⅰ度唇裂
B. Ⅱ度唇裂
C. Ⅲ度唇裂
D. 单侧完全性唇裂
E. 隐性唇裂

正确答案：B。Ⅱ度唇裂

解析：本题考查唇裂的分类。上唇部分裂开，鼻底完整属于Ⅱ度唇裂（B对）。1.国内常用的分类法：单侧唇裂：（1）Ⅰ度唇裂（A错）：仅限于红唇部分的裂开；（2）Ⅱ度唇裂：上唇部分裂开，但鼻底尚完整；（3）Ⅲ度唇裂（C错）：整个上唇至鼻底完全裂开。2.国际常用的分类法：单侧唇裂：（1）单侧不完全性唇裂（裂隙未裂至鼻底）；（2）单侧完全性唇裂（D错）（整个上唇至鼻底完全裂开）。